关于输卵管妊娠的诊断哪项是错误的
A. 有时没有停经史诊断仍可成立
B. 后穹隆穿刺抽不出血液可排除异位妊娠
C. 阴道有蜕膜管型排出有助诊断
D. 输卵管妊娠破裂常有晕厥与休克
E. 盆腔检查时宫颈可有举痛

正确答案：B。后穹隆穿刺抽不出血液可排除异位妊娠

解析：答案选B。只有在输卵管妊娠破裂出血的情况下后穹隆穿刺可抽出不凝血，如果输卵管妊娠没有破裂时抽不出血液。所以并不能根据这个来排除异位妊娠。当输卵管妊娠破裂，部分患者由于腹腔内急性出血常有晕厥与休克；盆腔检查宫颈举痛明显。掌握“异位妊娠”知识点。